牙周-牙髓联合病变的典型例子是
A. I度根分叉病变
B. 边缘性龈炎
C. 逆行性牙髓炎
D. 急性牙周脓肿
E. 慢性牙周脓肿

正确答案：C。逆行性牙髓炎

解析：本题考查牙周-牙髓联合病变。牙周-牙髓联合病变的典型例子是逆行性牙髓炎（C对）。逆行性牙髓炎是深牙周袋内的细菌、毒素通过根尖孔或近根尖孔处的侧支根管进入牙髓，先引起根尖处牙髓炎症，以后局限的慢性牙髓炎可急性发作；该病是由牙周病变引起的牙髓病变，是典型的牙周-牙髓联合病变。根分叉病变是指牙周炎的病变和破坏波及到多根牙的根分叉区，在该处出现牙周袋、附着丧失和牙槽骨吸收，Glickman将此病分为Ⅰ度（A错）、Ⅱ度、Ⅲ度、Ⅳ度；牙周脓肿是牙周炎发展到晚期，出现深牙周袋后的一个较常见的伴发症状，一般为急性过程，也可有慢性炎症，故分为急性牙周脓肿（D错），慢性牙周脓肿（E错）；这些病都是牙周病变引起，但是不存在牙髓病变，故不是牙周-牙髓联合病变。边缘性龈炎（B错）是最常见的牙龈病，由牙菌斑引起，牙龈炎症主要位于游离龈和龈乳头，也不是牙周-牙髓联合病变。